含有高浓度乙醇，内服外用均可的是
A. 碘甘油
B. 薄荷醑
C. 地高辛口服液
D. 复方磷酸可待因糖浆
E. 薄荷水

正确答案：B。薄荷醑

解析：本题考查醑剂。醑剂系指挥发性药物的浓乙醇溶液，如薄荷醑（B对），挥发性药物多数为挥发油。